治疗经间期出血湿热证,应首选
A. 两地汤
B. 逐瘀止血汤
C. 清肝止淋汤
D. 清热固经汤
E. 燥湿化痰汤

正确答案：C。清肝止淋汤

解析：湿邪阻于冲任胞络之间，蕴蒸生热，经间期重阴转阳，阳气内动，引动内蕴之湿热，扰动冲任血海，影响固藏，发为经间期出血，治疗当清利湿热，固冲止血。清肝止淋汤的功效为清利湿热，固冲止血，为经间期出血湿热证的首选（C对）。两地汤的功效为滋阴壮水，治疗肾阴虚证（A错）。逐瘀止血汤的功效为活血祛瘀，养阴止血，治疗血瘀证（B错）。清热固经汤的功效为清热凉血，固冲止血，治疗实热证（D错）。燥湿化痰汤燥湿理气化痰，和中利胆，治疗湿痰证（E错）。